口服吸收好，生物利用度高，属于5-羟色胺摄取抑制剂的抗抑郁药是
A. 氟西汀
B. 艾司佐匹克隆
C. 艾司唑仑
D. 齐拉西酮
E. 美沙酮

正确答案：A。氟西汀

解析：本题考查氟西汀。氟西汀（A对）为一种选择性5-HT再摄取抑制剂，通过增加突触间隙的5-HT浓度，从而增强中枢5-HT的功能，发挥抗抑郁作用。艾司佐匹克隆（B错）为非苯二氮䓬类镇静催眠药。艾司唑仑（C错）为苯二氮䓬类镇静催眠药，用于镇定、催眠、抗癫痫等。 齐拉西酮（D错）为非典型的抗精神病药物，对5-HT和去甲肾上腺素的再摄取，主要用于精神分裂。美沙酮（E错）为阿片受体激动剂，可用于创伤、手术、癌症等镇痛治疗，也可用于吗啡成瘾性替代治疗。